医疗卫生机构在分发时不得收取费用的是
A. 麻醉药品
B. 第一类精神药品
C. 第二类精神药品
D. 放射性药品
E. 第一类疫苗

正确答案：E。第一类疫苗

解析：本题考查疫苗的分类。医疗卫生机构在分发时不得收取费用的是第一类疫苗（E对）。《疫苗流通和预防接种管理条例》第一章总则第二条：疫苗分为两类。第一类疫苗，是指政府免费向公民提供，公民应当依照政府的规定受种的疫苗，包括国家免疫规划确定的疫苗，省、自治区、直辖市人民政府在执行国家免疫规划时增加的疫苗，以及县级以上人民政府或者其卫生主管部门组织的应急接种或者群体性预防接种所使用的疫苗；第二类疫苗，是指由公民自费并且自愿受种的其他疫苗。